根据藏药八性理论，土元偏盛药的性能是
A. 热、锐
B. 凉、钝
C. 轻、糙
D. 柔、软
E. 重、腻

正确答案：E。重、腻

解析：本题考查的是藏药的八性。根据藏药八性理论，土元偏盛药的性能是重、腻（E对）。八性：重、腻、凉、钝、轻、糙、热、锐。八性源于五元，其中土元偏盛药物性能则重、腻；水元偏盛药物性能则凉、钝（B错）；火元偏盛药物性能则热、锐（A错）；风元偏盛药物性能则轻、糙（C错）为。重、腻两性对治特性为轻、糙的隆病；凉、钝两性对治特性为热、锐的赤巴病；轻、糙、热、锐四性对治特性为重、柔、寒、钝的培根病。柔、软（D错）属于十七效。十七效：柔、重、温、腻、稳、寒、钝、凉、软、稀、燥、干、热、轻、锐、糙、浮。